高血压及动脉硬化常导致的脑血管病变是
A. 短暂性脑缺血发作
B. 脑血栓形成
C. 脑栓塞
D. 脑出血
E. 蛛网膜下腔出血

正确答案：D。脑出血

解析：高血压及动脉硬化常导致的脑血管病变的是脑出血（D对）。短暂性脑缺血发作主要与高血压、动脉粥样硬化、动脉狭窄、心脏病、血液成分改变及血流动力学变化等有关（A错）。脑血栓形成的病因是动脉粥样硬化和动脉炎（B错）。脑栓塞非心源性栓子常见的有动脉粥样硬化斑块脱落性血栓栓塞（C错）。蛛网膜下腔出血最常见的病因是先天性动脉瘤，其次是脑血管畸形和高血压动脉硬化性动脉瘤（E错）。